在水体发生严重污染事故时进行的水体污染的调查为
A. 监测性调查
B. 基础调查
C. 流行病学调查
D. 专题调查
E. 应急性调查

正确答案：E。应急性调查

解析：本题考查水体污染调查的相关内容。水体污染调查可分为基础调查、监测性调查、专题调查、应急性突发事件调查。在水体发生严重污染事故时进行的水体污染的调查为应急性调查（E对ABCD错）。